治疗肾虚喑痱的主方是
A. 龟鹿二仙胶
B. 地黄饮子
C. 百合固金汤
D. 大补阴丸
E. 炙甘草汤

正确答案：B。地黄饮子

解析：治疗肾虚喑痱的主方是地黄饮子。“喑痱”是由于下元虚衰，阴阳两亏，虚阳上浮，痰浊随之上泛，赌塞窍道所致。用以滋肾阴，补肾阳，开窍化痰（B对）。龟鹿二仙胶主治真元虚损，精血不足证（A错）。百合固金汤主治肺肾阴亏，虚火上炎证（C错）。大补阴丸主治阴虚火旺证(D错)。炙甘草汤主治阴血阳气虚弱，心脉失养证；虚劳肺痿（E）。